《难经经释》说：“邪扶生气而来，虽进而易退”是指
A. 子病犯母
B. 相乘传变
C. 相侮传变
D. 表里传变
E. 母病及子

正确答案：E。母病及子

解析：“邪扶生气而来，虽进而易退”，是说母气能生养子气，故母子相传，有母气相生之气扶持，病情虽有发展，但邪势减弱，或病势减退，因而病情较轻（E对）。子病犯母指五行中的某一行异常，累及其母行，终致子母两行皆异常（A错）。相乘传变是指五行中所不胜一行对其所胜一行的过度制约或克制（B错）。相侮传变指五行中所胜一行对其所不胜一行的反向制约和克制（C错）。表里传变可分为表邪入里和里病出表两种形式（D错）。